在下列流行病学调查方法中，研究时间较长，尤其对慢性病的观察费时更多的是
A. 病例-对照研究
B. 群组研究
C. 常规资料分析
D. 横断面研究
E. 纵向研究

正确答案：B。群组研究

解析：本题考查群组研究的特点。研究时间较长，尤其对慢性病的观察费时更多的是群组研究（B对）。群组研究由于需要大量人力物力，所以常在病例对照研究获得较明确的危险因素后用于进一步验证病因假设。病例-对照研究（A错）的特点是观察时间短、需要研究的对象少，适合研究一些病程较长的慢性病和一些比较少见的疾病。常规资料分析（C错）又称历史资料分析，即对已有的资料或者疾病监测记录做分析或总结。横断面研究（D错）又称现况调查，调查目标人群中某种疾病或现象在某一特定时点的情况。纵向研究（E错）又称疾病监测，即研究疾病或某种情况在一个人群中随着时间推移的自然动态变化。